五苓散的功能是
A. 温阳化气，利湿行水
B. 温阳散寒，益肾强腰
C. 健脾利湿，益肝补肾
D. 健胃理气，利湿和中
E. 行气化湿，健脾和胃

正确答案：A。温阳化气，利湿行水

解析：本题考查的是五苓散的功能。五苓散的功能是温阳化气，利湿行水（A对）。五苓散：【功能】温阳化气，利湿行水。木香顺气丸：【功能】行气化湿，健脾和胃（E错）。功能为温阳散寒，益肾强腰（B错）、健脾利湿，益肝补肾（C错）或健胃理气，利湿和中（D错）的中成药，2022年考试指南未明确说明。